临床上对不宜使用阿司匹林的头痛发热病人，宜用于
A. 对乙酰氨基酚
B. 双氯芬酸钠
C. 氯化钾
D. 碳酸锂
E. 氯丙嗪

正确答案：A。对乙酰氨基酚

解析：临床主要用于退热和镇痛。由于对乙酰氨基酚无明显胃肠刺激作用，故对不宜使用阿司匹林的头痛发热病人，适用本药。掌握“对乙酰氨基酚、布洛芬、塞来昔布”知识点。